中西药联用会降低疗效的药组
A. 参茸片和格列本脲
B. 灵芝片与苯巴比妥
C. 四逆汤与地高辛
D. 小青龙合剂与氨茶碱
E. 丹参注射液与多巴胺

正确答案：A。参茸片和格列本脲

解析：本题考查的是中西药联用的内容。中西药联用会降低疗效的药组是参茸片和格列本脲（A对）。中西成药联用药效学上的拮抗作用：若中西成药配伍不当，会使两者在疗效上发生拮抗作用，甚至产生严重的毒副作用。甘草、鹿茸具有糖皮质激素样作用，有水钠潴留和排钾效应，还能促进糖原异生，加速蛋白质和脂肪的分解，使甘油、乳酸等各种糖、氨基酸转化成葡萄糖，使血糖升高，从而减弱胰岛素、甲苯磺丁脲、格列本脲等降糖药的药效。因此含有甘草、鹿茸的中成药，如人参鹿茸丸、全鹿丸等，不能与磺酰脲类降糖药联用。灵芝片与苯巴比妥（B错）联用，起协同增效作用。大山楂丸、灵芝片、癫痫宁（含马蹄香、石菖蒲、甘松、牵牛子、千金子等）与苯巴比妥联用，治疗癫痫有协同增效作用。四逆汤与地高辛（C错）联用，起协同增效作用。木防己汤、茯苓杏仁甘草汤、四逆汤等与强心药地高辛等联用，可以提高疗效和改善心功能不全患者的自觉症状。小青龙合剂与氨茶碱（D错）联用，起协同增效作用。小青龙汤、柴朴汤等与氨茶碱、色甘酸钠等联用，可提高对支气管哮喘的疗效。丹参注射液与多巴胺（E错）联用，起协同增效作用。丹参注射液与间羟胺（阿拉明）、多巴胺等升压药同用，不但能加强升压作用，还能减少对升压药的依赖性。